男性，48岁，5年前曾患肺结核，近两月咳嗽，右胸痛，少量咳痰，间断咳痰带血，痰结核菌3次阴性，胸片无活动性结核病变，进一步应首先检查
A. 胸CT
B. 支气管碘油造影
C. 血沉
D. 结核菌素试验
E. 胸部X线检查

正确答案：A。胸CT

解析：中年男性，既往肺结核病史，近来咳嗽，右胸痛，少量咳痰，间断咳痰带血，痰结核菌3次阴性，胸片无活动性结核病变，根据该患者的病史、临床症状及体征、实验室检查，考虑最可能的诊断为肺癌，所以进一步应首先检查胸CT（A对），肺癌在CT上表现为分叶状肿块，有毛刺、切迹，明显不同于继发性肺结核在CT的表现。支气管碘油造影（B错）过去多用于支扩的诊断和病变范围，目前已很少应用。结核菌素试验（D错）在结核分枝杆菌感染的检出有很大限制，一般多用于卡介苗接种筛选。胸部X线检查（E错）该患者已做，且无活动性结核病变。血沉（C错）对于该患者的诊断意义不大。